根尖手术中最常见的沟内全厚瓣是
A. 扇形瓣
B. 矩形瓣
C. 不规则形瓣
D. 半圆形瓣
E. 半月形瓣

正确答案：B。矩形瓣

解析：根尖手术中最常见的龈沟内全厚瓣是三角形瓣和矩形瓣。掌握“根尖手术”知识点。